妇女妊娠晚期膳食中应注意少食下列哪项食物
A. 高蛋白
B. 高胆固醇
C. 高维生素
D. 高钙
E. 高卵磷脂

正确答案：B。高胆固醇

解析：妇女妊娠晚期如果多吃高胆固醇食物，可能会使血压升高，不利于了自身和胎儿的健康（B对）；怀孕后胎儿的发育生长需要蛋白质，孕妇也需要一定数量的蛋白质来满足子宫、乳房、的发育，另外在分娩过程中还需要储备一定量的蛋白质来促进产后恢复，以及防止产后贫血（A错）；维生素是调节和维持机体新陈代谢的重要成分，对胎儿来说，有利于血管健康、促进免疫系统的发育且可以防治母胎贫血（C错）；卵磷脂是胎儿神经发育的一种必需的营养素，怀孕期间给孕妇适量的补充卵磷脂，能够促进胎儿脑细胞的健康发育（E错）。